补体经典途径反应的次序是
A. C1→C2→C3……→C9
B. C1→C3→C2→C4……→C9
C. C1→C2→C3→C5……→C9
D. C1→C4→C2→C3→C5……→C9
E. C3→C5→C6……→C9

正确答案：D。C1→C4→C2→C3→C5……→C9